湿痰的特征是
A. 黄而黏稠，坚而成块
B. 白而清稀
C. 清稀而多泡沫
D. 白滑而量多，易咯
E. 少而黏，难咯

正确答案：D。白滑而量多，易咯

解析：湿痰的特征是痰白质滑量多，易于咯出，因脾失健运，水湿内停，湿聚为痰，上犯于肺所致。（D对）。痰黄质黏稠，甚则结块者（A错），多属热痰。痰白质清稀者（B错），多属寒痰。痰色白清稀而多泡沫者（C错），为风痰。痰少而质黏，难于咯出者（E错），多属燥痰。